男，51岁。进食质硬食物后呕鲜血500ml。查体：BP70/48mmHg，胸前区可见蜘蛛痣，肝脏肋下未触及，脾脏肋下3cm。目前应立即采取的措施是
A. 手术治疗
B. 液体复苏，抗休克治疗
C. 内镜治疗
D. 静脉注射止血环酸
E. 注射H₂受体拮抗剂

正确答案：B。液体复苏，抗休克治疗

解析：患者蜘蛛痣，脾大，提示门静脉高压，进食硬物后呕鲜血，提示有食管胃底静脉曲张，BP70/48mmHg，呕血500ml提示出血量大。液体复苏，抗休克治疗是消化道大出血的首要治疗措施，因此该患者立即采取的措施是液体复苏抗休克治疗（B对）。手术治疗目前已多不用于食管胃底静脉曲张出血的急诊治疗，因为并发症多，死亡率高（A错）。内镜治疗应该在液体复苏，抗休克治疗后采用，因此不是目前应立即采取的措施（C错）。静脉注射止血环酸可以用于食管胃底静脉曲张出血，但也要在液体复苏，抗休克治疗之后采用（D错）。注射H2受体拮抗剂常用于非静脉曲张出血，非静脉曲张出血以消化性溃疡出血多见，因此不是目前行立即采取的措施（E错）。